有上提腭垂作用的是
A. 舌腭肌
B. 咽腭肌
C. 悬雍垂肌
D. 腭帆张肌
E. 腭帆提肌

正确答案：C。悬雍垂肌

解析：软腭内有五对腭肌：腭帆张肌：作用为紧张腭帆，开大咽鼓管；腭帆提肌：使软腭上提，咽侧壁向内侧运动；舌腭肌：作用为下降腭帆；咽腭肌：上提咽喉；悬雍垂肌（腭垂肌）：上提悬雍垂（腭垂）。掌握“腭、舌、舌下区的局部解剖”知识点。